丁香的功效是
A. 温肾固精
B. 温肺化饮
C. 暖肝散结
D. 暖宫止带
E. 温中降逆

正确答案：E。温中降逆

解析：本题考查的是丁香的功效。丁香的功效是温中降逆（E对）。丁香：【功效】温中降逆，温肾助阳。益智仁：【功效】暖肾固精缩尿（A错），温脾止泻摄唾。干姜：【功效】温中，回阳，温肺化饮（B错）。艾叶：【功效】温经止血，散寒止痛。艾叶生用温经散寒湿、暖宫理气血而止痛、止血、止带（D错）。功效为暖肝散结（C错）的中药，2022年考试指南未明确说明。